下列说法符合我国人类辅助生殖技术的伦理原则的是
A. 对已婚女性可以实施商业代孕技术
B. 对离异单身女性可以实施商业代孕技术
C. 对任何女性都不得实施代孕技术
D. 对自愿的单身女性可以实施代孕技术
E. 对已婚女性可以实施亲属间的代孕技术

正确答案：C。对任何女性都不得实施代孕技术

解析：《人类辅助生殖技术管理办法》第三条规定，医疗机构和医务人员对任何人均不得实施任何形式的代孕技术（C对）。